急性胃炎的临床表现是
A. 呕吐物为隔餐食物，带腐臭味
B. 呕吐物为黄绿色，带粪臭味
C. 呕吐物为大量黏液及食物
D. 呕吐物为血液
E. 吐出胃内容物后仍干呕不止

正确答案：C。呕吐物为大量黏液及食物

解析：急性胃炎的临床表现是呕吐物为大量黏液及食物（C对）。呕吐物为隔餐食物，带腐臭味见于幽门梗阻（A错）。呕吐物为黄绿色，带粪臭味见于急性胆囊炎（B错）。呕吐物为血液见于上消化道出现（D错）。吐出胃内容物后仍干呕不止为早孕呕吐（E错）。